有关鼓膜错误的是：
A. 位于外耳道与鼓室之间
B. 鼓膜中心向外突起
C. 上1/4的三角区称为松弛部
D. 前下方有一三角形反光区称光锥
E. 无

正确答案：B。鼓膜中心向外突起

解析：鼓膜位于外耳道与鼓室之间（A对）。鼓膜边缘的大部分附着于颞骨上，中心向内凹陷 （B错，为本题正确答案）。鼓膜上1/4 角形区，薄而松弛，称为松弛部（C错）。紧张部前下方有一三角形的反光区，称光锥（D错）。